虽然（S）-异构体的活性比（R）-异构体强，但在体内会发生手性化，以外消旋体上市的药物是
A. 阿司匹林
B. 对乙酰氨基酚
C. 贝诺酯
D. 塞来昔布
E. 布洛芬

正确答案：E。布洛芬

解析：本题考查药物的结构。布洛芬（E对）（S）-异构体的活性比（R）-异构体强28倍，但布洛芬通常以外消旋体上市，因为布洛芬在体内会发生手性异构体间转化，无效的（R）-异构体可转化为有效的（S）-异构体。阿司匹林（A错）为环氧合酶（COX）的不可逆抑制剂，可以使COX发生乙酰化反应而失去活性。对乙酰氨基酚（B错）通过抑制下丘脑体温调节中枢前列腺素合成酶，减少前列腺素PGE₁、缓激肽和组胺等的合成和释放。贝诺酯（C错）为对乙酰氨基酚与阿司匹林形成的酯的前药，相对胃肠道反应小，在体内水解成原药，具有解热、镇痛及抗炎作用。塞来昔布（D错）是选择性抑制COX-2的非甾体抗炎药。